左室后壁心肌梗死，并伴有房室传导阻滞，其动脉栓塞可能累及
A. 前室间支
B. 后室间支
C. 左冠状动脉主干
D. 右冠状动脉主干
E. 右缘支

正确答案：D。右冠状动脉主干

解析：右冠状动脉主干（D对）分布于左室后壁的一部分和室间隔后1/3，当左室后壁心肌梗死，并伴有房室传导阻滞，其动脉栓塞可能累及右冠状动脉主干。